男性，18岁，右手背部深Ⅱ°烧伤10天，近一天出现乏力头痛及张口困难，不恰当的诊治措施是
A. 手背部烧伤部位清创
B. TAT2万U静脉注射
C. 腰穿脑脊液检查
D. 白蛋白20g静脉注射
E. 10%水合氯醛30ml保留灌肠

正确答案：C。腰穿脑脊液检查

解析：患者10天前手背部烧伤（外伤史），现出现张口困难，应考虑破伤风可能（凡有外伤史，如果伤后出现肌紧张、扯痛，张口困难、颈部发硬、反射亢进等，均应考虑破伤风的可能性）。患者头痛、张口困难为破伤风所致，并非颅内疾病所致，因此无需腰穿检查脑脊液（C错，为本题正确答案）。腰穿脑脊液检查为有创操作，会诱发破伤风痉挛发作，故应严禁腰穿。对手背部烧伤部位清创（A对），可从根本上清除破伤风梭菌。静脉注射大剂量破伤风抗毒素（TAT）（B对）可中和游离的毒素。由于破伤风病人不断阵发痉挛，出大汗等，每日消耗热量和水分丢失较多，因此需要十分注意营养（高热量、高蛋白、高维生素）补充，如静脉注射白蛋白（D对）。10%水合氯醛30ml保留灌肠（E对）可有效降低患者肌痉挛的次数，减少患者的痛苦。